下列哪些不属于青春期心理发展的特点
A. 心理发展与生理发育同步
B. 成人感和独立意向增强
C. 主观自我和客观自我分化
D. 自我意识的强度和深度不断增加
E. 自我评价能力趋于成熟

正确答案：A。心理发展与生理发育同步